抗菌药物临床应用应当遵循的原则是
A. 有效的原则
B. 安全的原则
C. 经济的原则
D. 安全、有效的原则
E. 安全、有效、经济的原则

正确答案：E。安全、有效、经济的原则

解析：抗菌药物临床应用应当遵循安全、有效、经济的原则。掌握“抗菌药物临床应用概述及管理”知识点。